嗜人类上皮细胞的病毒是
A. 狂犬病病毒
B. 人乳头瘤病毒
C. 人类细小病毒
D. 人类免疫缺陷病毒
E. 疱疹病毒

正确答案：B。人乳头瘤病毒

解析：人乳头瘤病毒（HPV）属于乳多空病毒科乳头瘤病毒属，HPV分为100个以上的型别，均特异性感染人的不同部位皮肤和黏膜上皮细胞。病毒感染仅停留于皮肤和黏膜中，不产生病毒血症。掌握“狂犬病、人乳头瘤病毒”知识点。